10岁男孩，因发热，关节肿痛，皮肤出现环形红斑，心率增快出现奔马律，血沉增快，经治疗上述症状体征消失后，需继发性预防的方法是
A. 避免关节损伤
B. 忌海鲜
C. 减少体育运动
D. 长效青霉素肌注
E. 激素吸入维持

正确答案：D。长效青霉素肌注

解析：风湿热在进行正规抗风湿热治疗而症状消失后，还应继续进行长效青霉素肌注（D对）以预防风湿热发作。发热、关节痛、心脏炎（心脏奔马律杂音、增大、心包炎等）、皮肤环形红斑是风湿热（P154）的主要临床表现。其实验室检查常有血沉增快，CRP（C-反应蛋白）阳性，白细胞增多和贫血。避免关节损伤（A错）属于幼年特发性关节炎（P158）的预防治疗。忌海鲜（B错）主要是针对海鲜过敏小儿的预防措施。减少体育运动（C错）、加强休息是减少诱发许多疾病（如哮喘）和愈后恢复的必要措施，并不是本题的最佳选项。激素吸入维持（E错）是小儿支气管哮喘（P245）长期控制的首选。